位于上皮层的最深面，是一层立方形或矮柱状的细胞的是
A. 角化层
B. 粒层
C. 棘细胞层
D. 基底层
E. 生发层

正确答案：D。基底层

解析：基底层：位于上皮层的最深面，是一层立方形或矮柱状的细胞。借基底膜与其下方的结缔组织相连。胞核卵圆形，染色深，有分裂繁殖能力，基底细胞和深部棘层细胞亦称生发层，能不断分裂增殖，可补充表层脱落的细胞。掌握“口腔黏膜基本结构”知识点。